重症肌无力属于
A. 酶缺陷所致疾病
B. 细胞蛋白缺陷所致疾病
C. 受体缺陷所致疾病
D. 膜转运障碍所致疾病
E. 基因突变所致疾病

正确答案：C。受体缺陷所致疾病

解析：重症肌无力患者体内有抗N型乙酰胆碱受体的抗体，该抗体能阻断运动终板上的nAChR与乙酰胆碱结合，导致肌肉收缩障碍,是受体缺陷所致的疾病（C对）。